下列不符合人类辅助生殖技术道德原则的是
A. 夫妻双方自愿和知情同意的原则
B. 维护社会公益的原则
C. 互盲和保密的原则
D. 确保后代健康的原则
E. 商品化的原则

正确答案：E。商品化的原则

解析：我国辅助生殖技术应用伦理准则包括严防商业化（E错，为本题正确答案）。人类辅助生殖技术必须在夫妇双方自愿同意并签署书面知情同意书后方可实施（A对）。我国辅助生殖技术应用伦理准则有利于患者、知情同意、保护后代、有社会公益、保守医密、严防商业化、伦理监督（B对）。互盲原则：凡使用供精实施的人类辅助生殖技术，供方与受方夫妇应保持互盲、供方与实施人类辅助生殖技术的医务人员应保持互盲、供方与后代保待互盲。医疗机构和医务人员对使用人类辅助生殖技术的所有参与者（例如卵子捐赠者和接受者）有实行匿名和保密的义务。匿名是藏匿供体的身份，保密是藏匿受体参与配子捐赠的事实以及对受者有关信息的保密（C对）。如果有证据表明实施人类辅助生殖技术将会对后代产生严重的生理、心理和社会损害，医务人员有义务停止该技术的实施（D对）。